一种疾病的病死率为
A. 每100000人的粗死亡率
B. 该病的死亡专率
C. 某疾病的死亡结果
D. 该病死亡在各种死亡中的比例
E. 该病患者的死亡百分比

正确答案：E。该病患者的死亡百分比

解析：本题考查病死率的概念。病死率表示一定时期内因某病死亡者占该病病人的比例（E对ABCD错），表示某病病人因该病死亡的危险性。